支气管哮喘患者发生Ⅰ型呼吸衰竭最主要的机制是
A. 肺泡通气量下降
B. 通气/血流比例失衡
C. 弥散性功能障碍
D. 肺内分流
E. 氧耗量增加

正确答案：B。通气/血流比例失衡

解析：I型呼吸衰竭即低氧性呼吸衰竭，特点是以低氧血症为主，不伴有高碳酸血症。支气管哮喘导致可逆的气流受限，使病变部位的肺泡通气不足，肺动脉血无法得到充分的氧合，通气/血流比值变小（B对），导致弥散障碍（C错）。因此，对于Ⅰ型呼吸衰竭，弥散障碍是其结果，通气/血流比值变小是其原理和机制。肺泡通气不足（A错）一般会造成氧分压降低，二氧化碳分压升高，是Ⅱ型呼吸衰竭的主要发病机制。肺内分流（D错）是指肺动脉内的静脉血未经氧合直接流入肺静脉，支气管哮喘病变部位主要是气道，一般不累及血管，一般不能造成这种情况。氧耗量增加（E错）常见于运动增加的情况下，重症哮喘氧耗量也可增加，但是正常人可以通过增加通气量来防止缺氧，只有在伴有通气功能障碍时，氧耗量增加才能造成呼吸衰竭，因此氧耗量增加通常不是主要机制。